四物汤的主治证是
A. 气衰血少
B. 劳倦内伤
C. 冲任虚损
D. 郁怒伤肝
E. 阴精亏虚

正确答案：C。冲任虚损

解析：四物汤方证由营血亏虚，血行不畅，冲任虚损所致（C对）。本方为补血调经的基础方。本方配伍动静相宜，补血而不滞血，行血而不 伤血，温而不燥，滋而不腻，为补血调血的良方。